不属于提高公众对口腔癌警告标志认识的是
A. 口腔有2周以上未愈合的溃疡
B. 口腔内有白色的斑
C. 口腔与颈部有不明原因的肿胀和淋巴结肿大
D. 口腔内不明原因的反复出血
E. 口内异味

正确答案：E。口内异味

解析：本题考查口腔癌的预防。不属于提高公众对口腔癌警告标志认识的是口内异味（E错，为本题的正确答案）。口腔癌警告标志：①口腔内有2周以上未愈合的溃疡（A对）；②口腔黏膜有白色、红色和发暗的斑（B对）；③口腔与颈部有不明原因的肿胀和淋巴结肿大（C对）；④口腔内有不明原因的反复出血（D对）；⑤面部、口腔、咽部和颈部有不明原因的麻木与疼痛。